患者，男，65岁。患有2型糖尿病，长期服用降糖药，同时长期服用阿司匹林肠溶片（100mg/d）预防心脑血管疾病。近期拟行髋关节置换手术，为减少出血风险，宜采取的措施是
A. 无需停用阿司匹林，也无需加用其它药物预防出血
B. 停用阿司匹林7～10天后，再行手术
C. 停用阿司匹林3天后，再行手术
D. 无需停用阿司匹林，在手术日加用维生素K₁预防出血
E. 无需停用阿司匹林，在手术日加用蛇毒血凝酶预防出血

正确答案：B。停用阿司匹林7～10天后，再行手术

解析：本题考查阿司匹林的使用。为减少出血风险，宜采取的措施是停用阿司匹林7～10天后，再行手术（B对）。阿司匹林是环氧化酶抑制剂，能够抑制TXA₂途径的血小板聚集，阿司匹林对血小板聚集的抑制作用可持续数日，可能导致手术中或手术后增加出血，有指南推荐，为减少出血风险，需提前停用阿司匹林7～10日。